在活体的心脏或血管内，血液发生凝固或血液中某些有形成分互相聚集形成的固体质块是
A. 血栓
B. 栓塞
C. 淤血
D. 栓子
E. 凝血

正确答案：A。血栓

解析：在活体的心脏或血管内，血液发生凝固或血液中某些有形成分互相聚集形成的固体质块是血栓（A对）。栓塞（P54）（B错）是指血液循环中，不溶于血液的异常物质随血流运行而阻塞血管腔的现象。淤血（P45）（C错）是指器官或局部组织静脉血液回流受阻，血液淤积于小静脉和毛细血管内。栓子（P54）（D错）是指在循环血液中出现的阻塞血管的异常物质，可以是固体、液体或气体。凝血（P54）（E错）是指血液由流动的液体状态变成不能流动的凝胶状态的过程，是生理性止血的重要环节。